某女，43岁，入睡困难，且多梦易醒，心悸健忘，精疲食少，四肢倦怠，腹胀便溏，面色少华，舌质淡，苔薄白，脉细无力，中医诊断为不寐。治疗宜选用的中成药是
A. 朱砂安神丸
B. 养血安神丸
C. 泻肝安神丸
D. 天王补心丸
E. 养心宁神丸

正确答案：E。养心宁神丸

解析：本题考查的是不寐的辨证论治。入睡困难，且多梦易醒，心悸健忘，精疲食少，四肢倦怠，腹胀便溏，面色少华，舌质淡，苔薄白，脉细无力，中医诊断为不寐。治疗宜选用的中成药是养心宁神丸（E对）。不寐心脾两虚证：【症状】不易入睡，多梦易醒，心悸健忘，神疲食少，伴头晕目眩，四肢倦怠，腹胀便溏，面色少华。舌淡苔薄，脉细无力。【中成药应用】常用中成药有北芪五加片、眠安宁口服液、脑力静糖浆。朱砂安神丸（A错）与天王补心丸（D错）为心悸阴虚火旺证的中成药应用。心悸阴虚火旺证：【症状】心悸易惊，心烦失眠，五心烦热，口干，盗汗，思虑劳心则症状加重，伴耳鸣腰酸，头晕目眩，急躁易怒。舌红少津，苔少或无，脉细数。【中成药应用】常用中成药有天王补心丸（水蜜丸）、朱砂安神片、宁神补心片、安神补心丸。泻肝安神丸（C错）为不寐肝火扰心证的中成药应用。不寐肝火扰心证：【症状】不寐多梦，甚则彻夜不眠，急躁易怒，伴头晕头胀，目赤耳鸣，口干而苦，不思饮食，便秘溲赤。舌红苔黄，脉弦而数。【中成药应用】常用中成药有泻肝安神丸、复方罗布麻颗粒。中成药应用为养血安神丸（B错）的病证，2022年考试指南未明确说明。